非处方药中解热镇痛药用于解热时，限定疗程为
A. 服用1日
B. 服用3日
C. 服用5日
D. 服用7日
E. 服用10日

正确答案：B。服用3日

解析：本题考查解热镇痛药的使用。非处方药中解热镇痛药用于解热时，限定疗程为服用3日（B对）。解热镇痛药用于退热一般不超过3天，如症状未缓解应及时就医，不得自行长期服用。用于疼痛时一般不超过5天（C错），如症状未缓解，可能是用药不对症或者病症比较严重，应去医院就诊，对症治疗。